男，58岁。消化不良3个月，伴腹部疼痛，消瘦半个月。胃镜显示胃小弯一大病灶。病理报告显示，细胞较小，大小一致，呈线状分布，内无腺管结构。诊断是
A. 胃未分化癌
B. 胃黏液腺癌
C. 胃乳头状腺癌
D. 胃印戒细胞癌
E. 胃管状腺癌

正确答案：A。胃未分化癌

解析：中年男性患者，消化不良3个月，腹部疼痛，消瘦半个月，胃镜见胃小弯一大病灶，考虑诊断为胃癌。细胞较小，大小一致，呈线状分布，内无腺管结构，此为胃未分化癌（A对）的病理特点。胃黏液腺癌（B错）的病理特点为癌细胞分泌大量黏液，癌组织肉眼呈半透明的胶冻状。胃乳头状腺癌（C错）和胃管状腺癌（E错）均属于胃腺癌，前者的病理特点为癌细胞排列成乳头状、腺管样结构；后者的病理特点为癌细胞排列成腺管样结构，无乳头结构。胃印戒细胞癌（P97）（D错）的病理特点为癌细胞胞浆内有大量黏液分泌，将细胞核挤向一侧，使癌细胞呈印戒状。